某因素与某病之间的关联强度最好用哪一指标衡量
A. 绝对危险度
B. 相对危险度
C. 特异度
D. 归因危险度百分比
E. 比值比

正确答案：B。相对危险度